钩体病的传染源
A. 山羊
B. 狗
C. 人
D. 鼠和猪
E. 鼠

正确答案：D。鼠和猪

解析：本题考查钩体病的传染源。钩体病的传染源主要为鼠和猪（D对ABCE错）。